公民、法人或者其他组织直接向人民法院提起行政诉讼的，应当在知道作出具体行政行为之日起
A. 十五日内提出
B. 二十日内提出
C. 一个月内提出
D. 二个月内提出
E. 三个月内提出

正确答案：E。三个月内提出